某校六年级（12岁年龄组）300名学生中恒牙有龋、失、补的人数为180人，未治龋齿数为328个，因龋失牙数为3个，因龋充填牙数为69个。根据WHO的评价标准，该群体龋病流行程度属于
A. 很低
B. 低
C. 中
D. 高
E. 很高

正确答案：B。低

解析：本题考查WHO龋病流行程度评价标准。某校六年级（12岁年龄组）300名学生中恒牙有龋、失、补的人数为180人，未治龋齿数为328个，因龋失牙数为3个，因龋充填牙数为69个。根据WHO的评价标准，该群体龋病流行程度属于低（B对）。龋均在1.2-2.6的范围内，等级为低，该龋均为（328+3+69）/300≈1.3。龋均在0.0-1.1的范围内，等级为很低（A错）；龋均在2.7-4.4的范围内，等级为中（C错）；龋均在4.5-6.5的范围内，等级为高（D错）；龋均在＞6.5的范围内，等级为很高（E错）。